常用的粉体粒径测定方法有
A. 气体透过法
B. 电感应法
C. 沉降法
D. 筛分法
E. 压汞法

正确答案：B、C、D。电感应法；沉降法；筛分法

解析：本题考查粉体粒径的测定方法。粉体粒径的测定方法包括：①显微镜法；②库尔特记数法；③沉降法（C对）；④筛分法（D对）；⑤电感应法（B对）。